对于唇、颊、舌病变，可行
A. 一般以示、中、无名三指平触
B. 双手合诊法
C. 双指双合诊法
D. 双指提拉式扪诊
E. 单指扪诊

正确答案：C。双指双合诊法

解析：对于唇、颊、舌病变，可行双指双合诊。掌握“口外一般检查及辅助检查”知识点。